眩晕头痛，胸膈痞闷，恶心呕吐，舌苔白腻，脉弦滑者，治宜选用
A. 温胆汤
B. 镇肝熄风汤
C. 羚角钩藤汤
D. 天麻钩藤饮
E. 半夏白术天麻汤

正确答案：E。半夏白术天麻汤

解析：该题考查半夏白术天麻汤的主治病证。眩晕头痛，胸膈痞闷，恶心呕吐，舌苔白腻，脉弦滑为风痰上扰证，温胆汤功能理气化痰，和胃利胆，主治胆郁痰扰证（A错）。镇肝息风汤功能镇肝息风，滋阴潜阳，主治类中风（B错）。羚羊钩藤汤功能凉肝息风，增液舒筋，主治肝热生风证（C错）。天麻钩藤饮功能平肝息风，清热活血，补益肝肾，主治肝阳偏亢，肝风上扰证（D错）。半夏白术天麻汤功能化痰息风，健脾祛湿，主治风痰上扰证（E对）。